有五个不同职业人群的冠心病患病率资料，若比较不同职业人群的冠心病患病率是否相同，若图示对比不同职业人群的冠心病患病率的高低，应绘制
A. 普通线形图
B. 直条图
C. 直方图
D. 圆图
E. 散点图

正确答案：B。直条图

解析：本题考查统计图。有五个不同职业人群的冠心病患病率资料，若比较不同职业人群的冠心病患病率是否相同，若图示对比不同职业人群的冠心病患病率的高低，应绘制直条图（B对）。普通线形图（A错）是用线段的升降来表示指标（变量）的连续变化情况，适用于描述一个变量随另一个变量变化的趋势。直方图（C错）是用直条矩形面积代表各组频数，各矩形面积总和代表频数的总和，主要用于表示连续变量频数分布情况。圆图（D错）是把圆的总面积作为100％，表示事物的全部，而圆内各扇形面积用来表示全体中各部分所占的比例常用于描述构成比资料。散点图（E错）是用点的密集程度和变化趋势表示两指标之间的直线或曲线关系。